用于治疗风寒湿痹，关节疼痛的生药有
A. 川乌
B. 黄芪
C. 黄芩
D. 防己
E. 葛根

正确答案：A。川乌

解析：本题考查的是川乌的主治病证。用于治疗风寒湿痹，关节疼痛的生药有川乌（A对）。川乌：【主治病证】（1）风寒湿痹，寒湿头痛。（2）心腹冷痛，寒疝腹痛。（3）局部麻醉（外用）。黄芪（B错）：【主治病证】（1）脾胃气虚，脾肺气虚，中气下陷，气不摄血，气虚发热。（2）自汗，盗汗。（3）气血不足所致的疮痈不溃或溃久不敛。（4）气虚水肿、小便不利。（5）气血双亏，血虚萎黄，血痹肢麻，半身不遂，消渴。黄芩（C错）：【主治病证】（1）湿温，暑湿，湿热胸闷、黄疸、泻痢、淋痛、疮疹。（2）热病烦渴，肺热咳喘，少阳寒热，咽痛，目赤，火毒痈肿。（3）血热之吐血、咳血、衄血、便血、崩漏。（4）胎热之胎动不安。防己（D错）：【主治病证】（1）风湿痹痛，尤以热痹为佳。（2）水肿，腹水，脚气浮肿，小便不利。葛根（E错）：【主治病证】（1）外感表证，项背强痛。（2）麻疹初起透发不畅。（3）热病烦渴，消渴证。（4）湿热泻痢初起，脾虚泄泻。